引导性组织再生术效果最好的是
A. Ⅱ度根分叉病变
B. Ⅲ度根分叉病变
C. 一壁骨下袋
D. 二壁骨下袋
E. 三壁骨下袋

正确答案：E。三壁骨下袋

解析：引导性牙周组织再生术（GTR）：窄而深的骨下袋为GTR的适应症，骨袋过宽则效果差。三壁骨袋因牙周膜细胞来源丰富且易于提供牙周膜细胞生长的空间，故效果最好，窄而深的二臂骨袋也是较好的适应症。掌握“慢性牙周炎的治疗原则、程序及方法”知识点。